前置胎盘的常见致病因素不包括
A. 受精卵滋养层发育迟缓
B. 子宫内膜炎
C. 双胎妊娠
D. 多次刮宫史
E. 初孕妇

正确答案：E。初孕妇

解析：前置胎盘的常见致病因素包括受精卵滋养层发育迟缓（A对）、子宫内膜炎（B对）、双胎妊娠（C对）、多次刮宫史（D对）、高龄初产妇（E错，为本题正确答案）等。